心包穿刺术的绝对禁忌证是
A. 心脏压塞
B. 化脓性心包炎
C. 肿瘤性心包炎
D. 结核性心包炎
E. 主动脉夹层

正确答案：E。主动脉夹层

解析：主动脉夹层（E对）是心血管疾病的灾难性危重急症，如不及时诊治，48小时内死亡率可高达50%。主要致死原因为主动脉夹层动脉瘤破裂至胸、腹腔或者心包腔，进行性纵隔、腹膜后出血，以及急性心力衰竭或者肾衰竭，此时做心包穿刺不但不能解决心包压塞症状，反而会造成出血，因此主动脉夹层是心包穿刺绝对的禁忌证。心包穿刺的目的包括①引流心包腔内积液，降低心包腔内压，是急性心脏压塞（A错）的急救措施；②通过穿刺抽取心包积液，做生化测定，涂片寻找细菌和病理细胞，以鉴别诊断各种性质的心包疾病，如结核性心包炎（D错）、肿瘤性心包炎等；③通过穿刺排脓、冲洗、注药，可作为化脓性心包炎（B错）的治疗手段。缩窄性心包炎（C错）患者的治疗多采取心包切除术，一般少用心包穿刺术，但其并非心包穿刺术的绝对禁忌证。